临产18小时，宫口开大2cm为
A. 正常产程
B. 活跃期延长
C. 潜伏期延长
D. 活跃期停滞
E. 第二产程停滞

正确答案：C。潜伏期延长

解析：临产18小时，经产妇>14小时，宫口开大2cm为潜伏期延长（C对）。高直位主要表现为胎头入盆困难，但高直前位部分可以衔接入盆，从而转为正常产程（A错）。持续性枕后位时，由于胎头俯屈不良，不能以枕下前囟径而以枕额径通过骨产道，使胎头通过产道的径线增大，阻力增加，故产程明显延长，尤其活跃期后产程进展缓慢，不利胎头下降，从而出现活跃期延长（B错）。破膜后，宫口扩张≥6cm，宫缩良好但宫口停止扩张≥4小时伴宫缩乏力，或宫口停止扩张≥6小时为活跃期停滞（D错）。第一产程进展顺利，胎头到达盆底受阻，不能通过出口横径，出现第二产程停滞，继发性宫缩乏力（E错）。